服用期间同时饮酒会降低抑制尿酸生成效果的药品是
A. 卡马西平
B. 别嘌醇
C. 秋水仙碱
D. 丙磺舒
E. 苯溴马隆

正确答案：B。别嘌醇

解析：本题考查饮酒对药物疗效的影响。服用期间同时饮酒会降低抑制尿酸生成效果的药品是别嘌醇（B对）。别嘌醇是抗痛风药，可以抑制尿酸生成，服用时饮酒会影响其抑制尿酸的效果。卡马西平（A错）也不宜与酒同服，在服用卡马西平期间饮酒，容易增强卡马西平的中枢抑制作用，从而对身体机体造成危害。秋水仙碱（C错）和丙磺舒（D错）服用时也应避免饮酒，酒精会增加血液中的尿酸水平，影响药物的体内尿酸排出效果，与抑制尿酸生成无关。苯溴马隆（E错）是促尿酸排泄的药物，酒精会因影响体内尿酸的排泄，与抑制尿酸生成无关。